原位癌是指
A. 早期癌
B. 原发癌
C. 癌前病变
D. 未发生转移的癌
E. 未突破基底膜的癌

正确答案：E。未突破基底膜的癌

解析：原位癌是指癌细胞累及上皮全层，但未突破基底膜的癌（E对）。早期癌（P209）（A错）是指癌组织浸润局限于黏膜层或黏膜下层的癌，无论有无淋巴结转移。癌前病变（P101）（C错）是指某些本身不是恶性肿瘤，但具有发展为恶性肿瘤潜能的疾病。